气态毒物进入呼吸道深部主要取决于下列哪种因素
A. 空气浓度
B. 水溶性
C. 脂溶性
D. 挥发性
E. 蒸气压

正确答案：B。水溶性

解析：本题考查气态毒物的吸收。气态毒物进入呼吸道的深度取决于其水溶性（B对ACDE错），水溶性较大的毒物，在上呼吸道即可引发刺激症状，除非浓度较高，一般不易到达肺泡；水溶性较小的毒物，因其对上呼吸道刺激较小，故易进入呼吸道深部而被吸收，导致急性肺水肿。此外，劳动强度、肺通气量与肺血流量以及生产环境的气象条件等因素也可影响毒物在呼吸道中的吸收。